具有很强的抗抑郁作用，对锂盐无效的躁狂、抑郁症有效的药物是
A. 苯妥英钠
B. 卡马西平
C. 苯巴比妥、扑米酮
D. 乙琥胺
E. 丙戊酸钠

正确答案：B。卡马西平